关于溶胶剂性质和制备方法的说法，错误的是
A. 溶胶剂属于非均匀状态液体分散体系
B. 溶胶剂中的胶粒属于热力学稳定系统
C. 溶胶剂中的胶粒具有界面动电现象
D. 溶胶剂具有布朗运动
E. 溶胶剂可用分散法和凝聚法制备

正确答案：B。溶胶剂中的胶粒属于热力学稳定系统

解析：本题考查溶胶剂。溶胶剂中的胶粒属于热力学不稳定系统（B错，为本题正确答案）。溶胶剂指固体药物细微粒子分散在水中形成的非均匀分散的液体制剂（A对）；溶胶剂中的胶粒具有界面动电现象（C对）；溶胶剂具有布朗运动（D对）；溶胶剂可用分散法和凝聚法制备（E对）。